治疗子宫肌瘤气滞血瘀证，应首选
A. 桂枝茯苓丸
B. 血府逐瘀汤
C. 失笑散
D. 膈下逐瘀汤
E. 桃红四物汤

正确答案：D。膈下逐瘀汤

解析：子宫肌瘤气滞血瘀证的病机是肝郁气滞，血行受阻，瘀滞胞宫，瘀积日久而成癥；治宜行气活血，化瘀消癥；选用疏肝解郁，化瘀止痛的膈下逐瘀汤（D对）。桂枝茯苓丸主治先兆流产血瘀证和卵巢肿瘤气滞血瘀证（A错）；血府逐瘀汤主治闭经气滞血瘀证和经前期综合征气滞血瘀证（B错）；失笑散功效是活血祛瘀，散结止痛（C错）；桃红四物汤的功效是活血养血（E错）。